上下颌突部分联合则形成大口畸形，属于
A. 唇裂
B. 横面裂
C. 斜面裂
D. 侧鼻裂
E. 下颌裂

正确答案：B。横面裂

解析：上下颌突未联合或部分联合，发生横面裂，如为部分联合则形成大口畸形。掌握“面部的发育”知识点。